医学伦理学的学科性质是指它属于
A. 医德学
B. 元伦理学
C. 应用伦理学
D. 道德哲学
E. 生命伦理学

正确答案：C。应用伦理学